根据《药品管理法》规定，从某国进口麻醉药品，海关放行应持有
A. 《医药产品注册证》
B. 《进口准许证》
C. 《进口药品注册证》
D. 《药品经营许可证》
E. 《进口药品通关单》

正确答案：B。《进口准许证》

解析：本题考查的是药品进口管理。根据《药品管理法》规定，从某国进口麻醉药品，海关放行应持有《进口准许证》（B对）。药品进口备案应当向货物到岸地口岸药品监督管理局提出申请，并由负责本口岸药品检验的口岸药品检验所进行检验。办理进口备案，报验单位应当填写《进口药品报验单》，持《进口药品注册证》（C错）（或者《医药产品注册证》（A错））（正本或者副本）原件，进口麻醉药品、精神药品还应当持麻醉药品、精神药品《进口准许证》原件，向所在地口岸药品监督管理局报送所进口品种的有关资料一式两份。